鼓室前壁有
A. 鼓室上隐窝
B. 岬
C. 蜗窗
D. 面神经管凸
E. 以上都不是

正确答案：E。以上都不是

解析：鼓室上隐窝的外侧壁即鼓室外侧壁（A错）。岬（B错），蜗窗（C错），面神经凸（D错，故E为本题正确答案）均位于鼓室内侧壁。